社会药店、医疗机构药房零售甲类非处方药的必要条件之一是配备
A. 药士
B. 执业药师
C. 老药工
D. 用药咨询人员
E. 专职采购人员

正确答案：B。执业药师

解析：本题考查执业药师。社会药店、医疗机构药房零售甲类非处方药的必要条件之一是配备执业药师（B对）。凡从事药品生产、经营、使用的单位均应配备相应的执业药师，并以此作为开办药品生产、经营、使用单位的必备条件之一。